当头直立位，口腔在不咀嚼、不吞咽、不说话时，下颌处于休息状态时的位置是
A. 牙位
B. 正中（牙合）位
C. 后退接触位
D. 牙尖交错位
E. 下颌姿势位

正确答案：E。下颌姿势位

解析：当头直立位，口腔在不咀嚼、不吞咽、不说话的时候，下颌处于休息状态，上下颌牙弓自然分开，从后向前保持着一个楔形间隙，称为息止（牙合）间隙，也称为自由间隙，约为1～3mm。此时下颌所处的位置，称为下颌姿势位。掌握“下颌姿势位、三类颌位与前伸、侧方（牙合）颌位”知识点。